在我国实施人类辅助生殖技术，下列各项中违背卫生部制定的伦理原则的是
A. 供精者的精子提供给3名妇女受孕
B. 医务人员为捐赠精子者保密
C. 对出售配子者置若罔闻
D. 给予捐赠者必要的交通补助
E. 经医学伦理委员会审查和在其监督中实施

正确答案：C。对出售配子者置若罔闻